患者，男，25岁。头发干枯脱落，头皮瘙痒，头屑多，头面部皮肤干燥脱屑，并见淡红色斑片，伴口干便秘，舌红，苔薄白，脉细数，其证是
A. 火毒炽盛证
B. 湿毒蕴阻证
C. 气血两虚证
D. 气血瘀滞证
E. 风热血燥证

正确答案：E。风热血燥证

解析：白屑风是一种发生在头皮的慢性疾病，因白屑层层飞扬而定名为白屑风。其临床特点以毛囊口棘状隆起 糠状鳞屑为特征，一般无自觉症状，或有轻度瘙痒，病程长，青壮年患者最多，或在乳儿期发生。风热血燥证证候表现为：发于头面部，为淡红色斑片，干燥、脱屑、瘙痒，受风加重，或头皮瘙痒，头屑多，毛发干枯脱落；伴口干口渴，大便干燥，舌质偏红，苔薄白或黄，脉细数。治宜祛风清热，养血润燥（E对）。